患儿，男，8个月。因患支气管肺炎，用多种抗生素治疗半月余，病情好转。近2天再次发热伴呕吐、腹泻，大便5～6次/日，腥臭，呈暗绿色水样便。镜检见大量白细胞、脓球。该患儿最可能的诊断是
A. 病毒性肠炎
B. 真菌性肠炎
C. 致病性大肠埃希菌性肠炎
D. 侵袭性大肠埃希菌性肠炎
E. 金黄色葡萄球菌性肠炎

正确答案：E。金黄色葡萄球菌性肠炎

解析：患儿，男，8个月。因患支气管肺炎，用多种抗生素治疗半月余（金黄色葡萄球菌性肠炎多继发于使用大量抗生素后），病情好转。近2天再次发热伴呕吐、腹泻（发热、呕吐、腹泻为肠炎的表现），大便5～6次/日，腥臭，呈暗绿色水样便（为金黄色葡萄球菌性肠炎大便特点）。镜检见大量白细胞、脓球（提示金黄色葡萄球菌性感染），综合该患者的病史、症状、查体，该患儿最可能的诊断是金黄色葡萄球菌性肠炎（E对）。病毒性肠炎主要的病原为轮状病毒（A错），表现为常伴发热和呼吸道感染症状，大便次数及水分多，呈黄色水样便或蛋花样便带少量黏液，常并发脱水、酸中毒及电解质紊乱。真菌性肠炎（B错）常并发于其他感染或肠道菌群失调时，常伴鹅口疮，大便泡沫多，带黏液，可见豆腐渣样细块，大便镜检有真菌孢子和菌丝。致病性大肠埃希菌性肠炎（C错）主要表现为排出大量水样便，导致患儿脱水和电解质紊乱。侵袭性大肠埃希菌性肠炎（D错）表现为高热、呕吐、腹痛，腹泻频繁，大便呈黏液状，带脓血。